溴氰菊酯的毒作用机制为
A. 抑制胆碱酯酶活性
B. 与巯基结合
C. 钠离子通道延迟
D. 抑制ALAD

正确答案：C。钠离子通道延迟

解析：本题考查拟除虫菊酯类农药的毒作用机制。拟除虫菊酯类农药是人工合成的结构上类似于天然除虫菊素的一类农药。溴氰菊酯是拟除虫菊酯的其中一种。拟除虫菊酯选择性地作用于神经细胞膜的钠离子通道，使其去极化后的钠离子通道M闸门关闭延缓（C对ABD错），钠通道开放延长，从而产生一系列兴奋症状。除神经毒性外，拟除虫菊酷类农药还具有生殖毒性。